结核性骨髓炎
A. 多见于儿童
B. 不发生骨折
C. 仅下颌骨发生
D. 不易引起化脓性感染
E. 不能形成脓肿、瘘管

正确答案：A。多见于儿童

解析：本题考查结核性骨髓炎及放射性骨髓炎。结核性骨髓炎常继发于身体其他部位的结核病，如肺等其他器官的结核病灶的结核杆菌通过血行侵入颌骨；通过牙龈等口腔黏膜的结核病灶直接侵犯、经开放性龋洞、拔牙创或在牙萌出期侵入颌骨较少见。一般多见于儿童（A对），上、下颌骨均可发生（C错）。常伴发一般化脓性感染（D错），其临床表现类似于慢性化脓性骨髓炎。可形成广泛的颌骨病变，易发生病理性骨折（B错）。也可形成冷脓肿、瘘管（E错）。